根据《中华人民共和国药品管理法》，下列情形属于假药的是
A. 不注明生产批号的
B. 被污染的
C. 擅自添加着色剂、防腐剂及辅料的
D. 超过有效期的
E. 药品所含成分与国家药品标准规定成分不符的

正确答案：E。药品所含成分与国家药品标准规定成分不符的

解析：本题考查假药的界定。根据《中华人民共和国药品管理法》，下列情形属于假药的是药品所含成分与国家药品标准规定成分不符的（E对）。假药的界定：《药品管理法》第九十八条第一款、第二款规定，禁止生产（包括配制，下同）、销售、使用假药。有下列情形之一的，为假药：①药品所含成分与国家药品标准规定的成分不符；②以非药品冒充药品或者以他种药品冒充此种药品；③变质的药品；④药品所标明的适应症或者功能主治超出规定范围。劣药的界定：根据《药品管理法》第九十八条第三款规定，有下列情形之一的，为劣药：①药品成分的含量不符合国家药品标准；②被污染的药品（B错）；③未标明或者更改有效期的药品；④未注明或者更改产品批号的药品（A错）；⑤超过有效期的药品（D错）；⑥擅自添加防腐剂、辅料的药品（C错）；⑦其他不符合药品标准的药品。